肾功能不全者的用药原则不包括
A. 避免或减少使用肾毒性大的药物
B. 避免与有肾毒性的药物联合使用
C. 肾功能不全而肝功能正常者可选用双通道（肝肾）排泄的药物
D. 定期监测肾功能，及时调整给药剂量
E. 避免或减少使用肝毒性大的药物

正确答案：E。避免或减少使用肝毒性大的药物

解析：本题考查肾功能不全者用药原则。肾功能不全者的用药原则不包括避免或减少使用肝毒性大的药物（E错，为本题正确答案）。肾功能不全患者用药原则：1.明确诊断，合理选药。2.避免或减少使用肾毒性大的药物（A对）。3.注意药物相互作用，特别应避免与具有肾毒性的药物合用（B对）。4.肾功能不全而肝功能正常者可选用经双通道（肝、肾）消除的药物（C对）。5.根据肾功能的情况调整用药剂量和给药间隔时间，必要时进行治疗药物监测（D对），设计个体化给药方案。